男，52岁。突发胸痛6小时，胸痛为持续性，呈刀割痛，向背部和腹部放射。既往有高血压病史20年。查体：左上肢血压170/100mmHg，右上肢血压100/60mmHg，双肺呼吸音清晰，心脏听诊A₂大于P₂。心电图正常。该患者最可能的诊断是
A. 不稳定型心绞痛
B. 急性心肌梗死
C. 急性心包炎
D. 主动脉夹层
E. 气胸

正确答案：D。主动脉夹层

解析：患者中年男性，既往有高血压病史20年，突发刀割样、持续性胸痛，并向背部和腹部放射（主动脉夹层典型的胸痛特点），左上肢血压170/100mmHg而右上肢血压100/60mmHg（双上肢血压相差较大，正常值小于10～20mmHg），结合患者的临床表现、体检和病史，该患者最可能的诊断是主动脉夹层（D对）。不稳定型心绞痛（P229）（A错）胸痛常为压迫、发闷或紧缩性，持续时间多为数分钟或数十分钟不等；急性心肌梗死（P236）（B错）常有发热、烦躁不安、出汗、恐惧，胸闷或有濒死感，且有特异性的心电图改变；急性心包炎（P302）（C错）常可于胸骨左缘第3、4肋间闻及特异性的心包摩擦音；气胸（P120）（E错）多为突发一侧针刺样疼痛，继之胸闷和呼吸困难，可伴有刺激性咳嗽，这四种疾病均不会出现双上肢血压相差较大的表现。